在病例对照研究中，病例的最佳选择是
A. 死亡病例
B. 自觉症状病例
C. 现患病例
D. 新发病例
E. 典型的重病例

正确答案：D。新发病例